能行气活血的味是
A. 淡味
B. 苦味
C. 酸味
D. 咸味
E. 辛味

正确答案：E。辛味